男，34岁，因急性阑尾炎穿孔伴局限性腹膜炎，行阑尾炎切除术后5天，仍有腹痛，腹胀，体温38℃以上，大便3～5次/天，有下坠感。血WBC18×10⁹/L。为明确诊断，首先应做的检查是
A. 伤口检查
B. B超
C. 直肠指诊检查
D. X线胸腹部摄片
E. 粪便常规检查

正确答案：C。直肠指诊检查

解析：青年男性患者，因急性阑尾炎穿孔板局限性腹膜炎行阑尾切除术，术后5天出现腹痛、腹胀，体温38℃以上（正常为36～37℃），血WBC18×10⁹/L（正常为4～10×10⁹/L，发热、白细胞计数升高提示感染），便频、有下坠感（直肠刺激症状），结合患者病史、体查和实验室检查，应首先考虑为盆腔脓肿。为明确诊断，首先应做的检查是直肠指诊（C对）。直肠指诊操作简便，检查若发现肛管括约肌松弛，在直肠前壁触及向肠腔内膨起、有触痛和波动感的肿物，结合患者病史则可确立盆腔脓肿的诊断。该患者无伤口感染，不需行伤口检查（A错）。B超检查（B错）可显示脓肿的位置和大小，有助于明确诊断，但由于操作相对较复杂，故不作为首选的检查方法。X线摄片（D错）对盆腔脓肿的显示效果不佳，一般不用。粪便常规检查（E错）主要用于肠道感染性疾病和寄生虫病的诊断，对盆腔脓肿的诊断价值不大。